男，60岁，尿频，夜尿3～4次，直肠指检：前列腺增大，质地偏硬，未触及硬结，血清PSA16.7ng/ml，Ｂ超显示，前列腺增生，残余尿量为20ml.CT尿路造影（CTU）显示双肾无积水，前列腺增生，下一步诊治方法应首选
A. 经尿道前列腺电切
B. 药物治疗
C. 前列腺穿刺活检
D. 根治性前列腺切除
E. 经尿道球高压扩张术

正确答案：C。前列腺穿刺活检

解析：老年男性患者，血清前列腺特异性抗原（PSA）16.7ng/ml，正常参考值为0～4ng/ml，前列腺增大，质地偏硬，CTU显示双肾无积水，说明为早期，综合患者的临床表现、实验室检查、影像学表现可诊断为前列腺癌，下一步诊治方案应首选前列腺穿刺活检（C对）加以确认。经尿道前列腺电切（A错）适用于良性前列腺增生。药物治疗（B错）适用于晚期前列腺癌，尤其是去势抵抗性前列腺癌（CRPC）。根治性前列腺切除（D错）适用于前列腺癌确诊后的治疗。经尿道球高压扩张术（E错）适用于尿路梗阻。